其循行均起于胞中的经脉是
A. 任脉督脉带脉
B. 阴维脉阳跷脉
C. 阳维脉阳跷脉
D. 冲脉任脉督脉
E. 任脉冲脉带脉

正确答案：D。冲脉任脉督脉

解析：督、任、冲三脉皆起于胞中（D对），同出于会阴，后别道而行，分布于腰背胸腹等处，称此三脉为“一源而三歧”。